桡动脉在腕部的摸脉位置是
A. 桡侧腕屈肌腱外侧
B. 桡侧腕屈肌腱内侧
C. 拇长伸肌腱外侧
D. 拇长展肌腱内侧
E. 掌长肌腱内侧

正确答案：A。桡侧腕屈肌腱外侧

解析：桡动脉在桡骨茎突的内上方即桡侧腕屈肌腱外侧（A对B错）位置表浅，为桡动脉在腕部的摸脉位置。